男，40岁，慢性膀胱刺激症状，伴排尿困难及尿流中断，改变体位后可继续排尿，应首先考虑
A. 膀胱结石
B. 急性膀胱炎
C. 膀胱肿瘤
D. 急性肾盂肾炎
E. 泌尿系结核

正确答案：A。膀胱结石

解析：膀胱结石的典型症状为排尿突然中断，疼痛放射至远端尿道及阴茎头部，伴排尿困难和膀胱刺激症状，小儿常用手搓拉阴茎，跑跳或改变排尿姿势后，能使疼痛缓解，继续排尿。患者未提及典型的排尿突然中断，故首先考虑膀胱结石（A对）。肾结核常发生于20-40岁的青壮年，男性较女性多见。随着病情的发展，可出现下列典型的临床表现，尿频尿急尿痛是肾结核的典型症状之一，血尿是肾结核的重要症状，常为终末血尿（E错）。因患者为慢性膀胱刺激症状，所以不是急性膀胱炎（B错）和急性肾盂肾炎（D错）。膀胱肿瘤常为全程无痛性血尿（C错）。